称为“刚脏”的是
A. 心
B. 肝
C. 脾
D. 肺
E. 肾

正确答案：B。肝

解析：本题考查的是五脏的特性。称为“刚脏”的是肝（B对）。肝位于右胁之内，横膈之下。肝具有刚强之性，喜条达舒畅而恶抑郁；内寄相火，主升主动，易亢易逆，故称“刚脏”。肝在志为怒，在体为筋，开窍于目，在液为泪，其华在爪，与春气相通应。肝与胆相表里，足厥阴经属肝而络于胆。心（A错）居于胸腔，横膈之上，有心包卫护于外。心为神之居，血之主，脉之宗，起着主宰生命活动的作用。心在志为喜，在体为脉，其华在面，开窍于舌，在液为汗，与夏气相通应。心与小肠相表里，手少阴经属心而络于小肠。脾（C错）位于中焦，横膈之下。脾为后天之本，气血生化之源，在志为思，在体为肉，主四肢，开窍于口，其华在唇，在液为涎，与长夏之气相通应，又有“脾寄旺于四时”之说。足太阴经属脾而络于胃。肺（D错）居胸腔，左右各一，上接气管、喉咙，与鼻相通。在诸脏腑中，肺位最高，故称“华盖”。由于肺叶娇嫩，不耐寒热，易被邪侵，故又称“娇脏”。肺在志为悲，在体为皮，其华在毛，开窍于鼻，在液为涕，与秋气相通应。肺与大肠相表里，手太阴经属肺而络于大肠。肾（E错）左右各一，位于腰部，故“腰为肾之府”。肾为先天之本、脏腑阴阳之本。肾在志为恐，在体为骨，齿为骨之余，其华在发，开窍于耳及前后二阴，在液为唾，与冬气相通应。肾与膀胱相表里，足少阴经属肾络膀胱。